出生时新生儿身长平均是
A. 36cm
B. 40cm
C. 46cm
D. 50cm
E. 56cm

正确答案：D。50cm

解析：身高指头部、脊柱与下肢长度的总和，而新生儿出生时身长平均为50cm（D对）。